追风透骨丸【处方】制川乌100g，白芷100g，制草乌100g，香附（制）100g，甘草100g，白术（炒）50g，没药（制）20g，麻黄100g，川芎100g，乳香（制）50g，秦艽50g，地龙100g，当归50g，茯苓200g，赤小豆100g，羌活100g，天麻50g，赤芍100g，细辛100g，防风50g，天南星（制）100g，桂枝50g，甘松50g。【制法】以上二十三味粉碎成细粉，过筛，混匀100g粉末用炼蜜55～65g。加适量水制成水蜜丸。另将滑石粉、红氧化铁、胭脂红适量，混匀作包衣材料包衣，干燥即得。《中国药典》对马兜铃酸进行限量检查，要求其含量不得0.001%的饮片是
A. 白芷
B. 羌活
C. 秦艽
D. 细辛
E. 制草乌

正确答案：D。细辛

解析：本题考查的是细辛的化学成分。《中国药典》对马兜铃酸进行限量检查，要求其含量不得0.001%的饮片是细辛（D对）。辽细辛的主要化学成分为挥发油、木脂素类和黄酮类等。挥发油约占其含量的3%。《中国药典》以细辛脂素为指标成分进行含量测定，含量不得少于0.050%。同时规定挥发油不得少于2.0%（ml/g）。细辛含有痕量的马兜铃酸Ⅰ，有肝肾毒性。《中国药典》对细辛的马兜铃酸Ⅰ进行限量检查，要求其含量不得过0.001%。马兜铃酸有较强的肾毒性，易导致肾功能衰竭。含有马兜铃酸的中药有马兜铃、关木通、广防己、细辛、天仙藤、青木香、寻骨风等。